腮腺开始发育于胚胎
A. 第5周
B. 第6周
C. 第7周
D. 第10周
E. 第12周

正确答案：B。第6周

解析：本题考查腮腺开始发育的时间。腮腺开始发育于胚胎第6周（B对），并起源于上、下颌突分叉处的外胚层上皮。